甲基硫氧嘧啶治疗甲状腺功能亢进症的机制是
A. 抑制食物中碘的吸收
B. 抑制甲状腺激素的合成
C. 抑制甲状腺激素的释放
D. 减少甲状腺激素的贮存
E. 对抗甲状腺激素的作用

正确答案：B。抑制甲状腺激素的合成

解析：甲状腺在体内的合成是在甲状腺球蛋白上进行的，血液中的碘化物被甲状腺细胞主动摄取，活性碘与TG上酪氨酸残基结合，生成一碘酪氨酸和二碘酪氨酸，在过氧化物酶的作用下，两个二碘酪氨酸耦连成T₄，一个一碘酪氨酸和一个二碘酪氨酸耦连成T₃，甲硫氧嘧啶属于硫脲类抗甲状腺素药，可抑制过氧化物酶，从而阻止酪氨酸的碘化及耦连，抑制甲状腺素的合成（B对）。甲基硫氧嘧啶对食物中碘的吸收（A错）无影响。甲硫氧嘧啶等硫脲类药物并不抑制储存在腺泡内的甲状腺激素的释放（C错），也不能拮抗甲状腺激素的作用（E错），故须待甲状腺内贮存的激素消耗到一定程度才能呈现疗效。甲基硫氧嘧啶对甲状腺激素的贮存（D错）无影响。